早期流产最常见的原因是
A. 孕妇黄体功能不足
B. 胚胎染色体异常
C. 孕妇生殖器官异常
D. 孕妇宫颈内口松弛
E. 孕妇免疫功能异常

正确答案：B。胚胎染色体异常

解析：早期流产最常见的原因为胚胎或胎儿染色体异常（B对）。孕妇黄体功能不足（A错）、孕妇生殖器官异常（C错）以及孕妇免疫功能异常（E错）可导致早期流产，但均不是最常见的原因。孕妇宫颈内口松弛（D错）常引起晚期流产。